患者，女，18岁，未婚。每于经行小腹绵绵作痛，经净渐除，经量少、质稀，腰酸腿软，舌苔薄白，脉细弱。其治法是
A. 益气止痛
B. 补血止痛
C. 滋阴止痛
D. 益肾养肝止痛
E. 疏肝止痛

正确答案：D。益肾养肝止痛

解析：患者肾气虚损，冲任俱虚，子宫、冲任失养，故小腹绵绵作痛，外府不荣则腰骶酸痛不适，精亏血少，阳气不足，故经少质稀，舌脉亦为肾气不足证。故治疗是要益肾养肝止痛（D对）。益气补血止痛多用于有气血虚弱如倦怠乏力，四肢无力等表现的痛经（AB错）。阴虚止痛法多用于有阴虚证候如五心烦热，夜寐不宁等表现的痛经（C错）。疏肝止痛多用于有肝气不舒并伴有胸胁乳房胀痛等表现的痛经（E错）。